关于尿激酶应用的说法，正确的有
A. 使用尿激酶时应注意监测出血风险
B. 为防止出血事件的发生，尿激酶溶栓后不可使用肝素类药物
C. 尿激酶可用于预防房颤患者发生血栓风险
D. 用于急性心肌梗死溶栓时，尿激酶可与阿司匹林合用以增强疗效
E. 尿激酶尽早（6～12h）使用，可用于治疗冠状动脉栓塞和心肌梗死

正确答案：A、C、D、E。使用尿激酶时应注意监测出血风险；尿激酶可用于预防房颤患者发生血栓风险；用于急性心肌梗死溶栓时，尿激酶可与阿司匹林合用以增强疗效；尿激酶尽早（6～12h）使用，可用于治疗冠状动脉栓塞和心肌梗死

解析：本题考查尿激酶的应用。尿激酶为溶栓药，使用尿激酶时应注意监测出血风险（A对）。尿激酶用于血栓栓塞性疾病的溶栓治疗，包括急性广泛性肺栓塞、胸痛6～12h内的冠状动脉栓塞和心肌梗死（E对）。尿激酶还可用于预防房颤患者发生血栓风险（C对）。用于急性心肌梗死溶栓时，尿激酶可与阿司匹林合用以增强疗效（D对），且不显著增加严重出血的发生率。使用尿激酶后是否使用肝素由医生决定，一般可皮下注射低分子肝素（B错）。